女性，58岁。2型糖尿病15年，长期口服格列本脲，10mg/日。查体：血压145/90mmHg，心、肺和腹部检查未见异常，双下肢无水肿。眼底检查，视网膜病变Ⅲ期。空腹血糖6.8mmol/L，餐后2小时血糖10.6mmol/L，血尿素氮6.2mmol/L，血肌酐92.8μmol/L，尿常规检查尿糖50mmol/L，蛋白阴性。经检查为糖尿病早期肾病，治疗应首选
A. 利尿剂
B. 血管紧张素转化酶抑制剂
C. α受体阻滞剂
D. β受体阻滞剂
E. 钙通道阻滞剂

正确答案：B。血管紧张素转化酶抑制剂

解析：糖尿病早期肾病出现微量蛋白尿，严格代谢控制可防止或延缓临床肾病的发生，减少蛋白质摄入量对早期肾病及肾功能不全均有利，抗高血压治疗可延缓肾小球滤过率的下降速度，早期肾病应用血管紧张素转化酶抑制剂和血管紧张素受体阻断剂有利于肾脏保护，减轻蛋白尿（B对）。早期肾病无水肿表现，可不用利尿治疗（A错），患者血压稍高，但α受体阻滞剂（C错）、β受体阻滞剂（D错）、钙通道阻滞剂（E错）虽有降压作用，但不是糖尿病肾病的情况的首选药物。